负责审查新食品原料安全性评估材料的部门是
A. 国家食品药品监督管理部门
B. 国家质量监督检验部门
C. 国家工商行政部门
D. 国家农业行政部门
E. 国家卫生行政部门

正确答案：E。国家卫生行政部门

解析：本题考查负责审查新食品原料安全性评估材料的部门。负责审查新食品原料安全性评估材料的部门是国家卫生行政部门（E对ABCD错）。